下列有关联合卡环叙述，不正确的是
A. 适用于非缺隙侧
B. 基牙牙冠长而稳固
C. 相邻两牙之间有间隙者
D. 可用于防止食物嵌塞
E. 两个卡环通过共同的卡环体连接

正确答案：B。基牙牙冠长而稳固

解析：联合卡环：由两个卡环通过共同的卡环体连接而成。卡环体位于相邻两基牙的（牙合）外展隙，并与伸向（牙合）面的（牙合）支托相连接。适用于非缺隙侧，基牙牙冠短而稳固，或相邻两牙之间有间隙者，联合卡环还可用于防止食物嵌塞。掌握“局部义齿固位体”知识点。